多为处于急性情绪危象，甚至精神崩溃或企图自杀的人提供的心理咨询形式为
A. 门诊心理咨询
B. 信函心理咨询
C. 电话心理咨询
D. 专题心理咨询
E. 网上心理咨询

正确答案：C。电话心理咨询